患者，男，65岁。皮肤、巩膜黄染进行性加重，大便持续变白，病后消瘦明显。应首先考虑的是
A. 急性病毒性肝炎
B. 肝硬化
C. 肝癌
D. 胰头癌
E. 胆总管结石

正确答案：D。胰头癌

解析：患者为老年男性，皮肤、巩膜黄染进行性加重，大便持续变白（陶土色大便），病后消瘦明显，患者临床表现与胰头癌相符，故应首先考虑的是胰头癌（D对）。急性病毒性肝炎（P412）（A错）起病较急，短期内出现意识障碍、出血、黄疸及肝脏缩小。肝硬化（P419）（B错）主要表现为食欲减退，恶心，呕吐，营养不良，皮肤、巩膜黄染，出血及贫血。肝癌（P429）（C错）起病隐匿，早期缺乏典型症状，主要表现为肝区疼痛、肝大、黄疸、呈进行性消瘦、发热、食欲减退、乏力、营养不良、恶病质等。胆总管结石（人卫八版外科学P453）（E错）约20%患者可以不感右上腹绞痛，40%的患者虽有绞痛但无黄疸，其余患者则多数在腹痛发生后数小时至1～2天开始有黄疸，且持续数天后逐渐消退。